某女，38岁。剖宫产生育一子，产后乳房结块、热疼痛，西医诊断为乳腺炎。因不愿使用抗生素治疗，遂求助中医。又因不便煎药，要求服用中成药，医师处以乳癖消胶囊。经治疗，乳房结块、红热疼痛不已。2年后，因乳急腺增生前来就诊。医师处以小金丸。关于使用小金丸注意事项的说法，错误的是
A. 孕妇禁用
B. 疮疡阳证者禁用
C. 哺乳期妇女禁用
D. 脾胃虚弱者禁用
E. 肝肾功能不全者慎用

正确答案：D。脾胃虚弱者禁用

解析：本题考查的是小金丸的注意事项。脾胃虚弱者慎用小金丸（D错，为本题正确答案）。小金丸：【注意事项】孕妇、哺乳期妇女禁用（AC对）。疮疡阳证者禁用（B对）。脾胃虚弱者慎用。不宜长期使用。肝、肾功能不全者慎用（E对）。脾胃虚弱者慎用海鲜等发物。